刺激下丘脑引起发热的是
A. IL–1
B. IL–2
C. IL–4
D. IL–5
E. IL–6

正确答案：A。IL–1

解析：IL-1刺激下丘脑体温调节中枢，引起发热。掌握“细胞因子及受体”知识点。